下列关于消化性溃疡的叙述，错误的是
A. 慢性病程，平均6-7年
B. 反复周期性发作
C. 可有多汗、失眠
D. 均有上腹疼痛症状
E. 部分以出血为首发表现

正确答案：D。均有上腹疼痛症状

解析：消化性溃疡是慢性过程，平均6-7年（A对），有的病史可达十余年，上腹痛或不适呈反复周期性发作（B对），可有多汗、失眠（C对）。临床上部分患者无溃疡病史，而是以出血为首发症状（E对）。部分病例无上述典型的疼痛，仅表现腹胀、厌食、嗳气、反酸等消化不良症状（D错，为本题正确答案）。